患儿，3岁。不思进食，泛恶，夜间哭闹少寐，腹胀，舌苔厚腻垢浊。其诊断是
A. 厌食
B. 积滞
C. 疳证
D. 口疮
E. 夜啼

正确答案：B。积滞

解析：患儿不思进食，泛恶，腹胀，当属于积滞（B对）。厌食见长期食欲不振，厌恶进食，一般无脘腹胀满、大便酸臭等症（A错）。疳证临床以形体消瘦，面色无华，毛发干枯，精神萎靡或烦躁，饮食异常为特征（C错）。口疮以齿龈、舌体、两颊、上颚等处出现黄白色溃疡，疼痛流涎，或伴发热为特征（D错）。夜啼也可见夜间哭闹少寐，但不伴不思进食，泛恶，腹胀（E错）。